口底多间隙感染一般是指
A. 双侧下颌下、舌下间隙同时受累
B. 双侧下颌下、颏下间隙同时受累
C. 双侧舌下、颏下间隙同时受累
D. 双侧下颌下、舌下、颏下间隙同时受累
E. 双侧下颌下、舌下、翼下颌间隙同时受累

正确答案：D。双侧下颌下、舌下、颏下间隙同时受累

解析：口底多间隙感染一般指双侧下颌下、舌下以及颏下间隙同时受累。掌握“口底多间隙感染”知识点。